男性，34岁，诊断急粒白血病M3，化疗时突发DIC，并迅速发展到消耗性低凝期，下列检查结果，哪项是不符合的
A. 血小板数量明显减少
B. 凝血酶原时间缩短
C. 纤维蛋白原浓度降低
D. 血小板因子IV水平增高
E. 抗凝血酶Ⅲ水平减低

正确答案：B。凝血酶原时间缩短

解析：白血病患者，化疗时突发DIC，目前处于消耗性低凝期，下列检查结果，不符合的是凝血酶原时间缩短（B错，为本题的正确答案），消耗性低凝期时凝血酶原时间显著延长，凝血因子和血小板被大量消耗（AE对），纤维蛋白原浓度降低（C对），血小板因子IV水平增高（D对）。